所示，取终寿区间成数a₀＝0.09。“0～”岁组的生存人年数L₀为
A. 96668
B. 97973
C. 96541
D. 100000
E. 96328

正确答案：B。97973

解析：本题考查生存人年数的计算。根据公式（17-5），将题中数据代入，“0～”岁组的生存人年数＝97772＋100000×0.02228×0.09＝97973（B对ACDE错）。